抑制HMG-CoA还原酶的药物是
A. 塞来昔布
B. 地高辛
C. 依那普利
D. 洛伐他汀
E. 米力农

正确答案：D。洛伐他汀

解析：本题考查抑制HMG-CoA还原酶的药物。抑制HMG-CoA还原酶的药物是洛伐他汀（D对）。他汀类药物是HMG-CoA还原酶的竞争性抑制剂，是目前治疗血脂障碍最有效的药物。目前临床常用的他汀类药物包括∶洛伐他汀、辛伐他汀、普伐他汀、氟伐他汀、阿托伐他汀、瑞舒伐他汀等。塞来昔布（A错）是选择性COX-2环氧酶抑制剂。地高辛（B错）属于强心苷类药物。依那普利（C错）为血管紧张素转化酶抑制剂。米力农（E错）为磷酸二酯酶抑制剂。